妊娠晚期心血管系统生理功能变化，错误的是
A. 心率增快而有心悸
B. 心脏容量增加10％左右
C. 叩诊心浊音界稍扩大
D. 心尖部可闻及柔和吹风样收缩期杂音
E. 增大的子宫压迫下腔静脉使血液回流受阻，心搏量减少

正确答案：E。增大的子宫压迫下腔静脉使血液回流受阻，心搏量减少

解析：妊娠晚期心血管系统生理功能变化包括：1.心脏 妊娠期增大的子宫使膈肌升高，心脏向左、上、前方移位，心脏沿纵轴顺时针方向扭转，加之血流量增加及血流速度加快，叩诊心浊音界稍扩大（C对），心尖搏动左移1～2cm。部分孕妇心尖部可闻及柔和吹风样收缩期杂音（D对）。心率增快而有心悸（A对），于妊娠晚期休息时每分钟约增加10～15次。至妊娠末期，心脏容量增加10%左右（B对）。2.心排出量 伴随着外周血管阻力下降，心率增加以及血容量增加，心搏量自妊娠10周逐渐增加，至妊娠32～34周达高峰持续至分娩。增大的子宫压迫下腔静脉使血液回流受阻，心搏量减少（E错，为本题正确答案）只出现于仰卧位这一体位情况下，称为仰卧位低血压综合征。3.血压 妊娠早期及中期血压偏低，妊娠24～26周后血压轻度升高。